对釉质进行酸蚀时，磷酸的最佳浓度是
A. 40%～60%
B. 10%～15%
C. 20%～30%
D. 30%～50%
E. 10%～30%

正确答案：D。30%～50%

解析：釉质的脱矿状态依磷酸的浓度和时间而变化，以30%～50%磷酸酸蚀刻釉质为宜。掌握“树脂粘结概念及釉质、牙本质粘结”知识点。